关于牙的组成，下列说法错误的是
A. 从牙体外部观察，每颗牙均由牙冠、牙根和牙颈三部分构成
B. 从纵剖面观察，牙体的组织包括牙釉质、牙骨质、牙本质和牙髓四部分构成
C. 牙冠是发挥咀嚼功能的主要部分
D. 牙根是牙体的支持部分，起稳固牙体的作用
E. 根尖孔仅是血管与牙周组织相连通的一种通道

正确答案：E。根尖孔仅是血管与牙周组织相连通的一种通道

解析：从牙体外部观察，每颗牙有牙冠、牙根和牙颈三部分构成；从纵剖面观察，牙体的组织包括釉质、牙骨质、牙本质与牙髓四部分构成；其中牙冠是牙发挥咀嚼功能的主要部分；牙根是牙体的支持部分，起稳固牙体的作用；牙髓中的血管、淋巴管和神经仅通过根尖孔与根尖部牙周组织相连通。掌握“牙的组成、分类、功能及牙位记录”知识点。